下列各项中，叩诊不会出现浊音的是
A. 肺不张
B. 肺空洞
C. 胸腔积液
D. 胸膜肥厚粘连
E. 未液化的肺脓肿

正确答案：B。肺空洞

解析：肺空洞（B错，为本题正确答案）常见于空洞型肺结核、液化破溃了的肺脓肿或肺肿瘤，叩诊出现鼓音而不会出现浊音。肺不张（A对）、胸腔积液（C对）、胸膜肥厚粘连（D对）、未液化的肺脓肿（E对）叩诊时一般可出现浊音。